女，35岁。慢性肾衰竭4年。一周来水肿加重，伴有恶心呕吐、胸痛、呼吸困难。查体：T38.1°C，BP180/110mmHg。心前区可闻及心包摩擦音。Hb63g/L，BUN28.6，血肌酐870.9mol/L。该患者病情危重的主要表现是
A. 内分泌失调
B. 水肿
C. 贫血
D. 高血压
E. 呼吸困难

正确答案：E。呼吸困难

解析：患者青年女性，慢性肾衰竭4年。一周来水肿加重，伴有恶心呕吐、胸痛、呼吸困难（心衰表现）。查体：T38.1°C（正常腋温36～37℃），BP180/110mmHg（正常血压90～120/60～90mmHg）。心前区可扪及心包摩擦音（心血管系统表现）。HB63g/L（女性正常值＞110g/L），BUN28.6（正常值2.9～7.5mmol/L），血肌酐870.9mol/L（女性正常值44～97μmol/L）。结合患者病史、体征及实验室检查，考虑诊断为慢性肾衰竭急性加重。该患者病情危重的主要表现为呼吸困难（E对），说明已出现左心衰竭。内分泌失调（A错）为肾衰竭患者一般临床表现，表现为水肾脏本身内分泌功能紊乱、糖耐量异常和胰岛素抵抗、下丘脑-垂体内分泌功能紊乱、外周内分泌功能紊乱。水肿（B错）多因水钠潴留而出现。贫血（C错）主要是因为肾组织分泌EPO减少所致。高血压（D错）出现在大部分肾功能受损的病人，多由水钠潴留、肾素-血管紧张素增高所致。